HCO₃⁻:16mmol/L，乳酸：4mmol/L，患者属于以下哪种酸碱平衡失调类型
A. 呼吸性酸中毒失代偿
B. 呼吸性酸中毒合并代谢性酸中毒
C. 呼吸性碱中毒代偿期
D. 代谢性酸中毒失代偿
E. 代谢性碱中毒代偿期

正确答案：D。代谢性酸中毒失代偿

解析：患者男，28岁，因外伤脾破裂行脾切除术1天。查体：T：36.5℃，P： 128次/分 ，R ：30次/分 ，BP：88/48mmhg。动脉血气分析：PH：7.28（正常值为7.35-7.45，低于正常值）、PaCO₂:35mmHg（正常值35～45mmHg），PaO₂:100mmHg，BE:-9mmol/L（正常值为-3mmol/L～+3mmol/L，低于正常值，代谢酸增加）、HCO₃⁻:16mmol/L（正常值：22-27mmol/L，低于正常值，代谢酸增加）， 乳酸 4mmol/L（存在乳酸堆积），患者存在代谢性酸中毒失代偿（D对）。